百合除润肺止咳外，又能
A. 滋阴除热
B. 补脾益气
C. 凉血止血
D. 清心安神
E. 清肝明目

正确答案：D。清心安神

解析：本题考查百合的功效。百合除润肺止咳外，又能清心安神（D对）。百合【功效】养阴润肺，清心安神。石斛【功效】养胃生津，滋阴除热（A错），明目，强腰。黄精【功效】滋阴润肺，补脾益气（B错）。小蓟【功效】凉血止血（C错），散瘀消痈。石决明【功效】平肝潜阳，清肝明目（E错）。